国家《室内空气质量标准》（适用于住宅和办公建筑物）规定要求：
A. ²²²Rn≤100Bq/m³
B. ²²²Rn≤200Bq/m³
C. ²²²Rn≤300Bq/m³
D. ²²²Rn≤400Bq/m³
E. ²²²Rn≤500Bq/m³

正确答案：D。²²²Rn≤400Bq/m³

解析：本题考查我国《室内空气质量标准（GB/T 18883-2002）》规定要求的氡²²²Rn浓度年平均值。我国《室内空气质量标准》（GB/T 18883-2002）规定，氡²²²Rn浓度年平均值（行动水平）≤400Bq/m³（D对ABCE错）。